硫酸奎宁中其他金鸡纳碱的检查方法是
A. 配置成50mg/ml的溶液，测定旋光度，不得过-0.4°
B. 配置成2.0mg/ml的溶液，在310nm处测定，吸收度不得大于0.05
C. 供试品溶液加稀盐酸5ml与三氯化铁试液2滴，不得显红色
D. 供试品加硝酸与水的混合液，除黄色外不得显红色或淡红棕色
E. 薄层色谱法

正确答案：E。薄层色谱法